地榆的原植物属于
A. 龙胆科
B. 葡萄科
C. 蔷薇科
D. 豆科
E. 五加科

正确答案：C。蔷薇科

解析：本题考查的是地榆的来源。地榆的原植物属于蔷薇科（C对）。地榆【来源】为蔷薇科植物地榆或长叶地榆的干燥根。后者习称“绵地榆”。秦艽【来源】为龙胆科（A错）植物秦艽、麻花秦艽、粗茎秦艽或小秦艽的干燥根，前三种按性状不同分别习称“秦艽”和“麻花艽”，后一种习称“小秦艽”。白蔹【来源】葡萄科（B错）植物白蔹的根。槐花【来源】本品为豆科（D错）植物槐的干燥花及花蕾。前者称“槐花”，后者称“槐米”。三七【来源】本品为五加科（E错）植物三七的干燥根及根茎。